主要用于预防疟疾的药物是
A. 乙胺嘧啶
B. 奎宁
C. 青蒿素
D. 伯氨喹
E. 氯喹

正确答案：A。乙胺嘧啶

解析：乙胺嘧啶（A对）主要用于病因预防。奎宁（B错）、青蒿素（C错）、氯喹（E错）主要用于控制症状。伯氨喹（D对）主要用于控制远期复发和复播。